一生中发展最成熟、精力最充沛年龄阶段
A. 婴幼儿期
B. 儿童期
C. 青年期
D. 中年期
E. 老年期

正确答案：D。中年期

解析：中年期是一生中发展最成熟、精力最充沛、工作能力最强，同时也是社会负担、心理压力最大的年龄阶段。中年人是整个社会的中坚力量。掌握“不同年龄阶段心理卫生”知识点。